可以加速多种药物代谢，对肝药酶有强诱导作用的药物是
A. 对氨基水杨酸钠
B. 乙胺丁醇
C. 异烟肼
D. 链霉素
E. 利福平

正确答案：E。利福平

解析：本题考查药物的不良反应。可以加速多种药物代谢，对肝药酶有强诱导作用的药物是利福平（E对）。利福平是CYP3A4的强效诱导剂，可加速多种药物的代谢。对氨基水杨酸盐（A错）主要的不良反应是胃肠道不适等。乙胺丁醇（B错）主要的不良反应是视神经炎（视力模糊、红绿色盲、视野受限），高尿酸血症，肝损害等。异烟肼（C错）主要的不良反应是周围神经炎、肝功能损害。链霉素（D错）主要的不良反应是听力障碍，眩晕，肾功能损害。